不属于连接体的是
A. 卡环与基托相连部分
B. 卡环与舌杆相连部分
C. 卡环与金属网状结构相连部分
D. 卡臂与（牙合）支托相连部分
E. 牙弓两侧鞍基相连部分

正确答案：D。卡臂与（牙合）支托相连部分

解析：连接体：是可摘局部义齿的组成部分之一，可将义齿的各部分连接在一起，同时还有传递和分散（牙合）力的作用，有大连接体和小连接体之分。大连接体的种类：腭杆、腭板、舌杆、舌板。小连接体：作用是把金属支架上的各部件，如卡环、支托等与大连接体相连接。掌握“局部义齿人工牙及基托”知识点。